主动被动型的特点是
A. 医患双方不是双向作用，而是医生对病人单向发生作用
B. 医患双方在医疗活动中都是主动的，医生有权威性，充当指导者
C. 医生和病人具有近似同等的权利
D. 长期慢性病人已具有一定医学科学知识水平
E. 急性病人或虽病情较重但他们头脑是清醒的

正确答案：A。医患双方不是双向作用，而是医生对病人单向发生作用

解析：主动被动型的特点是医患双方不是双向作用，而是医生对病人单向发生作用。在这种模式中，医患双方不是双向作用，而是医生对患者单向发生作用。医生的权威性得到了充分肯定，处于主动地位；患者处于被动地位，并以服从为前提（A对）。